分布在釉质厚度的内4/5处，改变入射光角度可以使明暗带发生变化，称为
A. 绞釉
B. 施雷格线
C. 无釉柱釉质
D. 釉小皮
E. 釉面横纹

正确答案：B。施雷格线

解析：施雷格线：用落射光观察牙齿纵向磨片时，可见宽度不等的明暗相间带，分布在釉质厚度的4/5处，改变入射光角度可以使明暗带发生变化，这些明暗带称为施雷格线。掌握“牙釉质”知识点。